以上疾病中属于丙类传染病的是
A. 艾滋病
B. 鼠疫
C. 脊髓灰质炎
D. 麻风病
E. 登革热

正确答案：D。麻风病